患者男性，52岁，有多年吸烟史，现在声音嘶哑伴小量咯血，应考虑的疾病是
A. 肺结核空洞形成
B. 支气管扩张
C. 肺脓肿
D. 支气管癌
E. 肺炎球菌性肺炎

正确答案：D。支气管癌

解析：本题患者有多年吸烟史，现声音嘶哑且伴小量咯血则可初步考虑为支气管肺癌。支气管肺癌出现咯血的发生机制主要是肿瘤损害支气管黏膜，毛细血管通透性增加，或黏膜下血管破裂出血所致（D对）；大量咯血常见于空洞性肺结核、支气管扩张症和肺脓肿（ABC错）；铁锈色血痰见于肺炎链球菌肺炎（E错）。